《中药材生产质量管理规范》是
A. 中药材生产和经营质量管理的基本准则
B. 中药材生产和质量管理的基本准则
C. 中药材按传统方法加工的基本准则
D. 道地药材加工的基本准则
E. 动物药按传统方法加工的基本准则

正确答案：B。中药材生产和质量管理的基本准则

解析：本题考查的是《中药材生产质量管理规范》。《中药材生产质量管理规范》是中药材生产和质量管理的基本准则（B对）。《中药材生产质量管理规范》（GAP）是中药材生产和质量管理的基本准则，适用于中药材生产企业生产中药材（含植物、动物药）的全过程。